肺气虚证常见的症状是
A. 咳喘无力，气短懒言
B. 干咳少痰，颧红潮热
C. 干咳无痰，鼻燥咽干
D. 咳嗽痰多，色白而粘
E. 咳嗽咯痰，发热恶寒

正确答案：A。咳喘无力，气短懒言

解析：本题考查的是肺气虚证的临床表现。肺气虚证常见的症状是咳喘无力，气短懒言（A对）。肺气虚证的临床表现，常见咳喘无力，气短懒言，声音低微，或语言断续无力，稍一用力则气吁而喘，周身乏力，自汗出，面色白，舌质淡嫩，脉虚弱等。干咳少痰，颧红潮热（B错）为肺阴虚证的临床表现。肺阴虚证的临床表现，常见咳嗽较重，干咳无痰，或痰少而黏，并有咽喉干痒，或声音嘶哑，身体消瘦，舌红少津，脉细无力。阴虚火旺还可见咳痰带血，干渴思饮，午后发热，盗汗，两颧发红，舌质红，脉细数。干咳无痰，鼻燥咽干（C错）为燥热犯肺证的临床表现。燥热犯肺证的临床表现，常见干咳无痰，或痰少而黏，缠喉难出，鼻燥咽干，舌尖红，苔薄白少津，脉浮细而数。并常伴有胸痛或发热头痛、身酸楚等症状。咳嗽痰多，色白而粘（D错）为痰浊阻肺证的临床表现。痰浊阻肺证的临床表现，常见咳嗽，痰量多，色白而黏，容易咳出，或见气喘、胸满、呕恶等症，舌苔白腻，脉象多滑。咳嗽咯痰，发热恶寒（E错）为风寒犯肺证的临床表现。风寒犯肺的临床表现，常见咳嗽或气喘，咳痰稀薄，色白而多泡沫，口不渴，常伴有鼻流清涕，或发热恶寒，头痛身酸楚，舌苔薄白，脉浮或弦紧。